骨髓象常见病态造血的是
A. 再生障碍性贫血
B. 慢性失血所致
C. 叶酸缺乏
D. 维生素B₁₂缺乏
E. 骨髓增生异常综合征

正确答案：E。骨髓增生异常综合征

解析：属于骨髓象常见病态造血的是骨髓增生异常综合征（E对）。再生障碍性贫血属于正细胞贫血（A错）。慢性贫血属于小细胞低色素贫血（B错）。叶酸缺乏、维生素B12缺乏都会导致巨幼细胞贫血，属于大细胞性贫血（CD错）。详细见（P536）“表6-2-1 贫血的细胞学分类”。